疫源地是指
A. 传染源所在地
B. 患者所在地
C. 疫点或疫区
D. 有病原体的地区
E. 上述均错

正确答案：C。疫点或疫区